为了使产生的泡沫持久，乳剂型气雾剂常加入的泡沫稳定剂是
A. 甘油
B. 乙醇
C. 维生素C
D. 尼泊金乙酯
E. 滑石粉

正确答案：A。甘油